瓜蒌除润肠通便外，又能
A. 下乳
B. 补虚
C. 清肺化痰
D. 凉血止血
E. 燥湿化痰

正确答案：C。清肺化痰

解析：本题考查的是瓜蒌的功效。瓜蒌除润肠通便外，又能清肺化痰（C对）。瓜蒌：【功效】清肺润燥化痰，利气宽胸，消肿散结，润肠通便。冬葵子：【功效】利水通淋，下乳（A错），润肠通便。仙鹤草：【功效】收敛止血，止痢，截疟，解毒，杀虫，补虚（B错）。石韦：【功效】利尿通淋，凉血止血（D错），清肺止咳。陈皮：【功效】理气调中，燥湿化痰（E错）。